不影响药物胃肠道吸收的因素是
A. 药物的解离常数和脂溶性
B. 药物从制剂中的溶出速度
C. 药物的粒度
D. 药物的旋光度
E. 药物的晶型

正确答案：D。药物的旋光度

解析：本题考查影响药物吸收的因素。药物的旋光度（D错，为本题正确答案）与药物的胃肠道吸收无关，与药物在体内的活性有关；影响药物吸收的理化因素包括：1.脂溶性和解离度（A对）；2.溶出速度（B对）；3.药物在胃肠道中的稳定性。4.药物的粒度和晶型（CE对）。